尺神经损伤的临床表现是
A. 五指爪形手畸形
B. 伸腕屈指障碍
C. 伸腕伸指障碍
D. 前臂旋转活动受限
E. Froment征阳性

正确答案：E。Froment征阳性

解析：尺神经易在腕部和肘部损伤，腕部损伤主要表现为骨间肌、蚓状肌、拇收肌麻痹所致的环、小指爪形手畸形（A错）及手指内收、外展障碍和Froment征（E对）以及手部尺侧半和尺侧一个半手指感觉障碍（B错），特别是小指感觉消失。桡神经损伤表现为伸腕、伸姆、伸指前臂旋后障碍及手背桡侧（虎口区）感觉异常（CD错）。